M受体的阻断剂是
A. 阿托品
B. 乙酰胆碱
C. 美加明
D. 十羟季铵
E. 筒箭毒碱

正确答案：A。阿托品